属于甲型强心苷类的化合物是
A. 蟾蜍甾二烯
B. 黄芩苷
C. 黄芪苷
D. 柴胡皂苷
E. 去乙酰毛花苷

正确答案：E。去乙酰毛花苷

解析：本题考查的是去乙酰毛花苷的化学结构。属于甲型强心苷类的化合物是去乙酰毛花苷（E对）。甲型强心苷元甾体母核的C-17侧链为五元不饱和内酯环；去乙酰毛花苷具有甲型强心苷元结构，苷元与三个D-洋地黄毒糖和一个葡萄糖连接。蟾蜍甾二烯（A错）类有游离型和结合型之分。游离蟾蜍甾二烯为乙型强心苷元结构，具有强心和止痛作用，主要成分为蟾毒灵、华蟾毒精、蟾毒它灵、脂蟾毒配基、日蟾毒它灵、蟾毒它里定等。黄芩中分离出来的黄酮类化合物有黄芩苷（B错）、黄芩素、汉黄芩苷、汉黄芩素等。黄芪中的化学成分众多，主要含皂苷类、黄酮类、多糖类及氨基酸类等，具有补气固表、利尿托毒、排脓、敛疮生肌等功效。药理试验表明，黄芪皂苷具有多种生物活性，其中黄芪甲苷（C错）是黄芪中主要生理活性成分，具有抗炎、降压、镇痛、镇静作用，并能促进再生肝脏DNA合成和调节机体免疫功能。柴胡中所含皂苷均为三萜皂苷，柴胡皂苷（D错）是柴胡的主要有效成分。